小青龙汤与抗组胺药联用可
A. 减轻便秘
B. 消除腹胀
C. 减轻肾功能损害
D. 减轻口渴
E. 减轻中枢兴奋

正确答案：D。减轻口渴

解析：本题考查的是中西药合理联用。小青龙汤与抗组胺药联用可减轻口渴（D对）。小青龙汤、干姜汤、柴朴汤、柴胡桂枝汤等与抗组胺药联用，可减少西药的用量和嗜睡、口渴等副作用。减轻便秘（A错）与消除腹胀（B错）为芍药甘草汤等与解痉药联用的效果。芍药甘草汤等与解痉药联用，在提高疗效的同时，还能消除腹胀、便秘等副作用。减轻肾功能损害（C错）为八味地黄丸、济生肾气丸、人参汤等中药与降血糖药联用的效果。八味地黄丸、济生肾气丸、人参汤等中药与降血糖药联用，可使糖尿病患者的性神经障碍和肾功能障碍减轻。减轻中枢兴奋（E错）为含麻黄类中药与巴比妥类西药联用的效果。用含麻黄类中药治疗哮喘，常因含麻黄素而导致中枢神经兴奋，若与巴比妥类西药成分联用，可减轻此副作用。